人类工效学的目的包括
A. 创造良好的工作环境
B. 保护劳动者的健康和安全
C. 提高工作效率
D. 以上都是
E. 以上都不是

正确答案：D。以上都是